美国PSI指数的评价因子不包含
A. SO₂
B. NO₂
C. CO
D. CO₂
E. O₃

正确答案：D。CO₂